涎腺分泌功能检查常选用的方法是
A. 酸性物刺激定性测定
B. 碱性物刺激定性测定
C. 核磁共振检查
D. 1天内自然分泌量
E. 某一时段内自然分泌量测定

正确答案：A。酸性物刺激定性测定

解析：①定性检查：给患者以酸性物质（临床上常以2%枸橼酸、维生素C和1%柠檬酸等置于舌背或舌缘），使腺体分泌反射性增加；根据腺体本身变化和分泌情况，判断腺体的分泌功能和导管的通畅程度。②定量检查：正常人每日唾液总量为1000～1500ml，其中90%为腮腺和下颌下腺所分泌，而舌下腺仅占3%～5%，小唾液腺则分泌更少，故唾液腺分泌功能的定量检查，是根据在相同程度刺激的条件下（临床上常用2%枸橼酸或1%柠檬酸），腮腺和下颌下腺的唾液分泌多少来协助某些唾液腺疾病的诊断。掌握“口外一般检查及辅助检查”知识点。